用于疾病诊断、治疗、监护的医疗器械是
A. 心电图机
B. 避孕工具
C. 手动轮椅
D. 手术器械
E. 心脏瓣膜

正确答案：A。心电图机